仅在复制过程中合成短链RNA分子的酶是
A. DNA连接酶
B. 核酸内切酶
C. 引物酶
D. DNA聚合酶
E. RNA聚合酶

正确答案：C。引物酶

解析：引物酶（C对）仅在复制过程中合成短链RNA分子。DNA连接酶（A错）连接复制中产生的单链缺口（P239），核酸内切酶（B错）为核酸的水解酶（P196）。DNA聚合酶（D错）催化脱氧核糖核苷酸间的聚合（P235），RNA聚合酶（E错）在转录中催化RNA合成。